男，20岁。头晕乏力2年，四肢皮肤有出血性瘀斑，肝可扪及，血象：血红蛋白50/L，白细胞2.0×10⁹/L，中性粒细胞0.33×10⁹/L，淋巴细胞0.67×10⁹/L，血小板20×10⁹/L，骨髓增生低下，巨核细胞缺失，酸溶血试验阴性。可诊断为
A. 白细胞不增多性白血病
B. 再生障碍性贫血
C. 特发性血小板减少性紫癜
D. 脾功能亢进
E. 阵发性睡眠性血红蛋白尿

正确答案：B。再生障碍性贫血

解析：患者眩晕乏力2年，四肢皮肤有出血性瘀斑，肝可扪及，血红蛋白、白细胞、淋巴细胞、血小板均减少，骨髓增生低下，巨核细胞缺如，酸溶血试验阴性，可以诊断为再生障碍性贫血（B对），白细胞不增多性白血病（A错）主要表现为贫血、出血、感染和浸润等征象。特发性血小板减少性紫癜（C错）血小板会明显减少，其它血细胞变化不明显。脾功能亢进（D错）、阵发性睡眠性血红蛋白尿（E错）不会有骨髓增生低下的表现。